正虚毒盛，不能托毒外达，疮形平塌，根脚散漫不收，难溃难腐的虚证，治疗应首选
A. 透托法
B. 温通法
C. 清热法
D. 消法
E. 补托法

正确答案：E。补托法

解析：托法可根据病人的体质强弱和邪毒盛衰状况，分为补托和透托两种方法。补托法用于正虚毒盛，正气不能托毒外达，疮形平塌、根脚散漫不收、难溃难腐的虚证（E对）。透托法（A错）用于毒气虽盛而正气未衰者，可用透脓的药物，促其早日脓出毒泄，肿消痛减，以免脓毒旁窜深溃。温通法（B错）是用温经通络、散寒化痰的药物以驱散阴寒凝滞之邪，为治疗寒症的主要法则。清热法（C错）用寒凉的药物使内蕴之热毒得以清解，为治疗外科多因火毒所生的的疮疡。消法（D错）是使初起的肿疡邪毒不致结聚成脓而得到消散的治法。